药物与特异性受体结合后，可能激动受体，也可能阻断受体，这取决于
A. 药物的作用强度
B. 药物是否具有亲和力
C. 药物的剂量大小
D. 药物的脂溶性
E. 药物是否具有内在活性

正确答案：E。药物是否具有内在活性

解析：药物是否和特异性受体有亲和力是能否激活或阻断受体的前提。但和受体结合后能产生多大的效应则决定于药物激活受体的能力，即内在活性大小（E对）。根据药物的内在活性，可把作用于受体的药物分为激动药、拮抗药和部分激动药三类。